某地一位司机在车祸中受重伤，被同行的人送到附近一家医院抢救。经查:病人多发性骨折，多脏器破裂，如不及时手术，就会使病人死亡。手术需要亲属签协议书。可病人的同行者谁也不敢代替家属签名。这时，主刀医师的上级医生签了协议书，表示承担责任。经过医务人员的全力抢救，病人脱险。对该上级医生的做法作出的正确伦理评价应该是
A. 正确，医生在医患关系中居主导地位，最有权力决策
B. 正确，权威医生在任何时候都可以代替病人做主
C. 正确，医生既已受到病人信托，必要时必须承担责任
D. 错误，未经家属委托
E. 错误，医生本人和医院承担的风险太大

正确答案：C。正确，医生既已受到病人信托，必要时必须承担责任